加味逍遥丸除疏肝清热外，又能
A. 消肿止痛
B. 益气和营
C. 益中健脾
D. 健脾消食
E. 健脾养血

正确答案：E。健脾养血

解析：本题考查的是加味逍遥丸的功能。加味逍遥丸除疏肝清热外，又能健脾养血（E对）。加味逍遥丸：【功能】疏肝清热，健脾养血。紫金锭：【功能】辟瘟解毒，消肿止痛（A错）。薯蓣丸：【功能】调理脾胃，益气和营（B错）。健脾消食丸：【功能】健脾，和胃，消食（D错），化滞。功能为益中健脾（C错）的中成药，2022年考试指南未明确说明。